一般来说，使医患之间信托-契约关系能够得到理想体现的是
A. 双方冲突型
B. 患者主导型
C. 主动-被动型
D. 指导-合作型
E. 共同参与型

正确答案：E。共同参与型

解析：共同参与模式：医患双方有近似同等的权利，共同参与医疗的决定与实施。从理论上讲，这种医患关系是最理想的，不但可以提高诊治水平，而且有利于建立和谐的医患关系。所以考虑使医患之间信托-契约关系能够得到理想体现的是：共同参与型。掌握“医患关系伦理”知识点。